不含味蕾的结构是
A. 菌状乳头
B. 轮廓乳头
C. 丝状乳头
D. 叶状乳头
E. 软腭粘膜

正确答案：C。丝状乳头

解析：菌状乳头(A对)、轮廓乳头(B对)及叶状乳头(D对)还有软腭粘膜(E对)上均含味蕾，而丝状乳头上无味蕾(C错，为本题正确答案)。